病例对照研究的病例组
A. 可来源于医院
B. 可来源于一般人群
C. 两者均是
D. 两者均否

正确答案：C。两者均是

解析：本题考查病例对照研究病例组的来源。病例对照研究中，病例的来源主要有两种：①从医院选择病例；②从社区人群中选择病例。题中两者均是（C对ABD错）病例对照研究中病例组的来源。